缺牙多于两个乳磨牙应选择
A. 带环（全冠）丝圈保持器
B. Nance腭弓式间隙保持器
C. 远中导板保持器
D. 充填式保持器
E. 可摘式功能性保持器

正确答案：E。可摘式功能性保持器

解析：可摘式功能性保持器适应证：乳磨牙缺乏两个以上，或两侧乳磨牙缺失，或伴有前牙缺失。掌握“乳牙早失及间隙管理”知识点。